萎缩性胃炎，胃黏膜的病理改变是
A. 充血、水肿
B. 糜烂、出血
C. 肥厚、粗糙
D. 灰暗、变薄
E. 渗出

正确答案：D。灰暗、变薄

解析：萎缩性胃炎的胃黏膜表面反复受到损害后导致黏膜固有腺体萎缩，甚至消失，因此胃黏膜有不同程度的变薄，颜色灰暗（D对），并伴有肠上皮化生，炎症反应及不典型增生。胃黏膜充血、水肿（A错），糜烂、出血（B错）为急性胃炎的病理改变。胃黏膜肥厚、粗糙为胃癌的病理改变。胃黏膜渗出可为胃溃疡的病理改变（E错）。